以下哪一项是种植体周围炎发病的重要促进因素
A. 菌斑微生物
B. 生物力学负载过重
C. 吸烟
D. 酗酒
E. 患者的全身健康状况

正确答案：B。生物力学负载过重

解析：本题考查种植体周围组织疾病。咬合负载过重（B对）是种植体周围炎发病的重要促进因素。